据《灵枢·决气》所述，“耳聋”由于
A. 血脱
B. 精脱
C. 气脱
D. 液脱
E. 津脱

正确答案：B。精脱

解析：原文“岐伯曰：精脱者，耳聋（B对）；气脱者，目不明（C错）；津脱者，腠理开，汗大泄（E错）；液脱者，骨属屈伸不利、色夭、脑髓消、胫酸、耳数鸣（D错）；血脱者，色白，夭然不泽（A错）、其脉空虚，此其候也。”